LD₀₁是指
A. 绝对致死剂量
B. 最小致死剂量
C. 最大耐受剂量
D. 半数致死剂量

正确答案：B。最小致死剂量

解析：本题考查LD₀₁。LD₀₁即最小致死剂量（B对ACD错），指一组受试实验动物中，仅引起个别动物死亡的最小剂量。